气孔特异、内陷，保卫细胞侧面观呈哑铃形或电话听筒形的药材是
A. 麻黄
B. 广藿香
C. 槲寄生
D. 薄荷
E. 穿心莲

正确答案：A。麻黄

解析：本题考查的是麻黄的显微鉴别。气孔特异、内陷，保卫细胞侧面观呈哑铃形或电话听筒形的药材是麻黄（A对）。麻黄【显微鉴别】粉末麻黄、蜜麻黄：气孔特异，内陷，保卫细胞侧面观呈哑铃状。纤维多而壁厚，附有小晶体（砂晶和方晶）。角质层极厚，呈脊状突起。广藿香（B错）【显微鉴别】叶片粉末：淡棕色。①非腺毛1～6细胞，平直或先端弯曲，长约至590㎛，壁具刺状突起，有的胞腔含黄棕色物质。②叶表皮细胞不规则形，气孔直轴式，副卫细胞清晰可见。③腺鳞头部扁球形，由8个细胞组成，直径37～70㎛，柄单细胞，极短。④小腺毛头部2细胞，柄1～3细胞，甚短。⑤草酸钙针晶细小，散在于叶肉细胞中，长约至27㎛。⑥间隙腺毛存在于栅栏组织或薄壁组织的细胞间隙中，头部单细胞，呈不规则囊状，直径13～50㎛，长约至113㎛，柄短，单细胞。槲寄生（C错）【显微鉴别】茎粉末：淡黄色。①表皮细胞类方形，可见气孔。②纤维成束，壁较厚，略成波状，微木化。③异形细胞形状不规则，壁较厚，微木化，胞腔大。④石细胞类方形、类多角形或形状不规则。薄荷（D错）【显微鉴别】叶横切面：①上表皮细胞呈方形，下表皮细胞细小扁平，均被角质层，有气孔；上下表皮凹陷处有腺鳞。②栅栏组织通常为1列细胞。③海绵组织为4～5列细胞。主脉上下表皮内方有厚角组织及薄壁组织。④主脉维管束外韧型，木质部导管常2～6个排列成行，韧皮部细胞细小。⑤表皮细胞、叶肉细胞、薄壁细胞及导管中有时含有橙皮苷结晶。穿心莲（E错）【显微鉴别】粉末上下表皮均有增大的晶细胞，内含大型螺状钟乳体，较大端有脐样点痕，层纹波状。下表皮气孔直轴式，副卫细胞大小悬殊，少数为不定式。另有腺鳞和非腺毛。